卫生法的执法范围包括有
A. 行政许可
B. 行政强制
C. 行政处罚
D. 行政复议
E. 以上均是

正确答案：E。以上均是